上3腭侧有下列神经吻合
A. 上牙槽前神经与上牙槽中神经
B. 鼻腭神经与腭中神经
C. 腭前神经与腭中神经
D. 腭中神经与腭后神经
E. 腭前神经与鼻腭神经

正确答案：E。腭前神经与鼻腭神经

解析：本题考查腭前神经阻滞麻醉。鼻腭神经分布于上颌1的牙髓和1～3的腭侧黏骨膜及牙龈，腭前神经分布于上颌3～8的腭侧黏骨膜及牙龈，两者在上3腭侧相吻合（E对）。上牙槽前神经分布于上颌1～3的牙髓及其牙周膜、牙槽骨、唇侧牙龈；上牙槽中神经分布于上颌4～5的牙髓及上6的近中颊根髓、牙周膜、牙槽骨、颊侧牙龈（A错）。腭中神经与腭后神经分布于软腭及腭扁桃体（BCD错）。